不符合风湿热诊断标准的主要表现是
A. 发热
B. 游走性多发性关节炎
C. 舞蹈病
D. 皮下结节
E. 环形红班

正确答案：A。发热

解析：发热是诊断风湿热的次要表现（A对）。风湿热的主要表现有5个：游走性多发性关节炎（B错）、心脏炎、皮下结节（D错）、环形红斑（E错）、舞蹈病（C错）。